关于椎骨与肾的位置关系，错误的是
A. 两肾上端靠近椎骨，下端远离
B. 右肾较左肾略低半个椎体
C. 左肾上端平第11胸椎下缘
D. 肾大约有两个椎体的高度
E. 左肾下端平第2-3腰椎椎间盘之间

正确答案：D。肾大约有两个椎体的高度

解析：左肾在第 11 胸椎椎体下缘（C对）至第 2-3 腰椎椎间盘之间（E对）；右肾则在第 12 胸椎椎体上缘至第 3 腰椎椎体上缘之间，故可知右肾较左肾略低半个椎体（B对）且肾大约有4个锥体的高度（D错,为本题正确答案）。两肾上端距正中线平均为 3. 8cm; 下端距正中线平均为 7.2cm，故可得两肾上端靠近椎骨，下端远离（A对）。